下列属于对冲性脑挫裂伤的是
A. 额部着力出现额叶的损伤
B. 枕部着力出现枕叶的损伤
C. 左颞顶着力出现左顶叶的损伤
D. 着力点处大脑凸面的损伤
E. 左枕着力出现右额颞极的损伤

正确答案：E。左枕着力出现右额颞极的损伤

解析：对冲伤指同时发生于着力部位以及着力部位的对侧的颅脑损伤，结合颅内解剖相关知识，左枕着力出现右额颞极的损伤（E对）为对冲性脑挫裂伤。